寒痰的特征是
A. 黄而黏稠，坚而成块
B. 白而清稀
C. 清稀而多泡沫
D. 白滑而量多，易咯
E. 少而黏，难咯

正确答案：B。白而清稀

解析：寒痰的特征是痰白质清稀，因寒邪阻肺，津凝不化，聚而为痰，或脾阳不足，湿聚为痰，上犯于肺所致（B对）。痰黄质黏稠，甚则结块者（A错），多属热痰。痰色白清稀而多泡沫者（C错），为风痰。痰白质滑量多，易于咯出者（D错），多属湿痰。痰少而质黏，难于咯出者（E错），多属燥痰。